吴茱萸碱所属的结构类型是
A. 有机胺类生物碱
B. 色胺吲哚类生物碱
C. 双吲哚类生物碱
D. 单萜吲哚类生物碱
E. 简单吲哚类生物碱

正确答案：B。色胺吲哚类生物碱

解析：本题考查的是生物碱的结构分类。吴茱萸碱所属的结构类型是色胺吲哚类（B对）。吲哚类生物碱主要由色氨酸衍生而成，根据其结构特点，主要分为四类：（1）简单吲哚类（E错）：如板蓝根、大青叶中的大青素B，蓼蓝中的靛苷等。（2）色胺吲哚类：此类化合物中含有色胺部分，结构较简单。如吴茱萸中的吴茱萸碱。（3）单萜吲哚类（D错）：这类生物碱的结构较复杂，如萝芙木中的利血平、番木鳖中的士的宁等。（4）双吲哚类（C错）：是由两分子单吲哚类生物碱聚合而成的衍生物，如长春花中具有抗癌作用的长春碱和长春新碱。有机胺类生物碱（A错）：这类生物碱的结构特点是氮原子不在环状结构内，如麻黄中的麻黄碱，秋水仙中的秋水仙碱，益母草中的益母草碱等。